白细胞分化成熟不同阶段的所表达的细胞表面标志是
A. CD
B. CAM
C. CR1
D. CKR
E. FcR

正确答案：A。CD